下颌闭口运动时稳定关节盘的是
A. 翼内肌深头
B. 颞肌
C. 翼外肌上头
D. 翼外肌下头
E. 翼内肌浅头

正确答案：C。翼外肌上头

解析：本题考查下颌运动的基本形式。下颌闭口运动时稳定关节盘的是翼外肌上头（C对）。闭口运动的力：颞肌、咬肌及翼内肌的收缩，牵引下颌向前上方运动，使下颌回到牙尖交错位，翼外肌上头在髁突回位、关节盘向前旋转中起稳定关节盘的作用。